具有平肝潜阳、息风止痉功效的药物是
A. 石决明
B. 羚羊角
C. 磁石
D. 僵蚕
E. 地龙

正确答案：B。羚羊角

解析：磁石是重镇安神药，其余四个选项均为平肝熄风药。羚羊角咸、寒；入肝、心经。咸寒质重，有平抑肝阳作用；长于清肝热，息肝风，止痉搐（B对），为治肝风内动，惊痫抽搐之要药。石决明可平肝潜阳，清肝明目。专入肝经，长于潜降肝阳，清泄肝热，兼益肝阴，为平肝凉肝之要药（A错）。磁石入肝、肾经，既能平肝阳，又能益肾阴，无息风止痉的功效（C错）。僵蚕入肝、肺二经，既能息风止痉，又能化痰定惊，故对惊风、癫痫挟有痰热者尤为适宜（D错）。地龙性寒，既能息风止痉，又擅清热定惊，故适用于热极生风所致的神昏谵语、痉挛抽搐及小儿惊风、癫狂等症（E错）。